急性肾盂肾炎可出现并发症
A. 心力衰竭
B. 肾性贫血
C. 高血压脑病
D. 肾静脉血栓
E. 肾周脓肿

正确答案：E。肾周脓肿

解析：急性肾盂肾炎并发化脓性感染而形成肾周脓肿（E对）。心力衰竭一般见于心脏疾病（A错）。肾性贫血一般见于促红细胞生成素减少（B错）。高血压脑病一般见于高血压（C错）。肾静脉血栓一般见于肾病综合征（D错）。